既可内服又可眼用的剂型为
A. 锭剂
B. 钉剂
C. 条剂
D. 灸剂
E. 膜剂

正确答案：E。膜剂

解析：本题考查锭剂的概念。既可内服又可眼用的剂型为膜剂（E对）。膜剂：1.特点：膜剂系指原料药物与适宜的成膜材料经加工制成的膜状制剂。供口服或黏膜用。2.分类：膜剂按结构类型可分为单层、多层及夹心型。按给药途径可分为内服膜剂、口腔用膜剂、眼用膜剂、皮肤及黏膜用膜剂等。锭剂（A错）：锭剂系指饮片细粉加适宜黏合剂（或利用饮片细粉本身的黏性)制成不同形状的固体制剂。有长方形、纺锤形、圆柱形、圆锥形等。供内服，可吞服或研细以水或黄酒化服，外用多是研细用醋或酒调敷，也可作嗅入或外搽药用。钉剂（B错）：钉剂系指饮片细粉加糯米混匀后加水加热制成软材，分剂量，搓成细长而两端尖锐（或锥形）的外用固体制剂。钉剂多含有毒性药物或腐蚀性药物，其赋形剂的选择类似于糊丸，具缓释作用。一般供外科插入，用于治疗痔、瘘管及溃疡等。条剂（C错）：条剂系指用桑皮纸粘药膏后搓捻成细条，或用桑皮纸搓捻成条，粘一层面糊，再粘药粉而制成的外用制剂，又称纸捻。条剂有韧性可用于弯曲分岔的瘘管，制备简单，使用方便。所用药物多有毒性或腐蚀性，主要用于中医外科插入疮口或瘘管，以引流脓液，拔毒去腐，生肌敛口。灸剂（D错）：灸剂系指将艾叶捣、碾成绒状，或另加其他药料捻制成卷烟状或其他形状，供熏灼穴位或其他患部的外用制剂。灸剂按形状可分为：艾头、艾柱、艾条3种；按加药与否分为艾条与含药艾。借助燃烧产生的温热性刺激及药物的局部透皮吸收，达到预防或治疗疾病的目的。